下列腧穴在五行相配中，属“土”的是
A. 鱼际
B. 曲池
C. 陷谷
D. 尺泽
E. 灵道

正确答案：B。曲池

解析：根据阳井金，阴井木进行配属。阴经的井荥输经合属木火土金水，阳经的井荥输经合属金水木火土。曲池是大肠经的合穴属土（B对）。鱼际是肺经的荥穴属火（A错）。陷谷是胃经的输穴属木（C错）。尺泽是肺经的合穴属水（D错）。灵道是心经的经穴属金（E错）。